动作电位产生过程中，K⁺外流增多，出现
A. 极化
B. 去极化
C. 复极化
D. 超极化
E. 反极化

正确答案：C。复极化